被誉为食物成分表之父的是
A. 英国学者Perey&Vaquelin
B. 英国营养学家McCance和Widdowson
C. 德国科学家Josef Konig
D. 我国生物化学学家吴宪教授
E. 美国科学家Atwater和Woods

正确答案：C。德国科学家Josef Konig

解析：本题考查食物成分表之父。1878年，德国科学家Josef Konig（C对ABDE错）出版了第一部真正意义上的食物成分表，被称为食物成分表之父。